期望继续享有患者角色所获得的利益，是患者角色的
A. 角色行为缺如
B. 角色行为冲突
C. 角色行为减退
D. 角色行为强化
E. 角色行为异常

正确答案：D。角色行为强化